女，35岁。发现左颈前部一无痛性肿块一年，约1cm大小，近一个月来出现声音嘶哑。查体：甲状腺左下极质硬结节，直径1.5cm，随吞咽活动，颈部未触及肿大淋巴结。最可能的诊断是
A. 甲状腺囊肿
B. 甲状腺舌骨囊肿
C. 甲状腺癌
D. 甲状腺腺瘤
E. 结节性甲状腺肿

正确答案：C。甲状腺癌

解析：女性患者，甲状腺左下极存在一无痛性硬结，近一个月出现声音嘶哑，提示病变累及喉返神经。结节直径仅1.5cm，尚不足以直接压迫喉返神经，提示病变直接侵犯喉返神经，多为恶性病变，因此最可能的诊断是甲状腺癌（C对）。甲状腺囊肿（A错），甲状腺腺瘤（D错），结节性甲状腺肿（E错）均为良性病变，不直接侵犯喉返神经。甲状腺舌骨囊肿（B错）位于颈前正中区，不会出现在甲状腺左下极。